下腔静脉阻塞时血流方向是
A. 腹壁静脉血流方向脐以上向上，脐以下向下
B. 腹壁静脉血流方向脐以上向上，脐以下向上
C. 腹壁静脉血流方向脐以上向下，脐以下向下
D. 腹壁静脉血流方向脐以上向下，脐以下向上
E. 胸壁静脉血流方向向下

正确答案：B。腹壁静脉血流方向脐以上向上，脐以下向上

解析：当下腔静脉堵塞时，在脐水平以上和脐以下浅静脉血流方向自下而上（B对）。正常人或肝硬化门脉高压病人的腹壁静脉血流方向，在脐水平以上自下而上注入上腔静脉，在脐水平以下自上而下注入下腔静脉（A错）。当上腔静脉堵塞时，在脐水平以上和脐以下浅静脉血流方向自上而下（C错）。门静脉阻塞有门脉高压时血流方向不是腹壁静脉血流方向脐以上向下，脐以下向上（D错）。正常胸壁静脉不易显现，当上腔或下腔静脉阻塞时，可见胸壁静脉充盈或曲张。当上腔静脉梗阻时胸壁静脉血流方向向下（E错）。